关于外科感染的特点，错误的是
A. 多为混合性感染
B. 有明显的局部症状
C. 常需外科处理感染
D. 伴器质性病变
E. 不会引起严重的全身性感染

正确答案：E。不会引起严重的全身性感染

解析：外科感染是指需要外科治疗的感染，既包括局部感染，又包括全身性感染，如脓毒症和菌血症等（E错，为本题正确答案）。具有如下特点（七版黄家驷外科学）：①常发生在创伤和手术后，与体表皮肤和黏膜完整性的破坏紧密相关（皮肤及粘膜破损处有明显的局部症状）（B对）；②常由一种以上的病原微生物引起（A对）；③大多不能自愈或单靠抗菌药物治愈，常需进行外科处理（C对）；④除了发生于创伤或疾病的原发部位之外，还可作为并发症发生于原发部位以外的其他组织或器官（D对）。